近年来，性传播疾病地区分布的趋势为
A. 从沿海地区渐向内地
B. 从北方向南方
C. 从农村到城市
D. 没有地区变化
E. 从内地向沿海

正确答案：A。从沿海地区渐向内地

解析：本题考查性传播疾病的地区分布。性传播疾病地区分布的趋势为从沿海地区渐向内地（A对BCDE错）。我国性传播疾病地区分布特点为：沿海省市高于内地，经济发达地区高于经济落后地区，城市高于农村。